更年期激素替代治疗可导致
A. 卵巢肿瘤发生的可能
B. 子宫内膜癌和乳腺癌发生的可能
C. 输卵管癌发生的可能
D. 宫颈癌发生的可能
E. 外阴癌发生的可能

正确答案：B。子宫内膜癌和乳腺癌发生的可能

解析：本题考查雌激素替代疗法禁忌证。雌激素替代疗法禁忌证包括：①患雌激素依赖性肿瘤如子宫内膜癌、乳腺癌（B对ACDE错）、子宫肌瘤等；②存在子宫内膜癌的高危因素，包括本人或其家族有癌症病史，患者肥胖、高血压、糖尿病，未产或产次低、月经周期异常或患多囊卵巢综合征等；③有严重肝病或胆汁淤积性疾病；④有心、肾疾病引起的水、钠潴留；⑤患血管栓塞性疾病。